残余的牙板上皮可成为牙源性上皮性肿瘤或囊肿的来源，也可能被重新激活形成
A. 马牙
B. 上皮珠
C. 上皮根鞘
D. 多生牙
E. 异形牙

正确答案：D。多生牙

解析：在某些情况下，残留的牙板上皮（Serre上皮剩余）可成为牙源性上皮性肿瘤或囊肿的起源，也可能被重新激活形成多生牙。掌握“牙体、牙周组织的形成”知识点。